某女44岁。与同事争吵后出现胃脘胀痛，连及胁助，嗳气时作，食欲不振嘈杂吞酸，舌淡红，苔薄白，脉弦。宜选用的方剂是
A. 丹栀逍遥散加减
B. 柴胡疏肝散加减
C. 二陈汤加减
D. 保和丸加减
E. 良附丸加减

正确答案：B。柴胡疏肝散加减

解析：本题考查的是胃痛的辨证论治。与同事争吵后出现胃脘胀痛，连及胁助，嗳气时作，食欲不振嘈杂吞酸，舌淡红，苔薄白，脉弦。宜选用的方剂是柴胡疏肝散加减（B对）。胃痛又称胃脘痛，是以上腹胃脘部近心窝处疼痛为主要表现的疾病。西医学的胃炎、消化性溃疡、功能性消化不良等疾病以上腹部疼痛为主要表现者，可参考此内容辨证论治。（一）寒邪客胃证：【症状】胃痛暴作，喜温恶寒，得温痛减，口和不渴，或喜热饮。舌淡，苔薄白，脉弦紧。【方剂应用】基础方剂为良附丸（高良姜、香附）加减（E错）。（二）饮食伤胃证：【症状】胃脘疼痛，胀满拒按，嗳腐恶食，或吐不消化食物，吐后或矢气后痛减，大便不爽。舌淡红，苔厚腻，脉滑。【方剂应用】基础方剂为保和丸（山楂、神曲、茯苓、半夏、莱菔子、陈皮、连翘、麦芽）加减（D错）。（三）肝气犯胃证：【症状】胃脘胀痛，痛连两胁，遇烦恼则痛作或痛甚，嗳气、矢气则舒，脘闷嗳气，善太息，大便不畅。舌淡红，苔薄白，脉弦。【方剂应用】基础方剂为柴胡疏肝散（柴胡、香附、枳壳、芍药、陈皮、川芎、炙甘草）加减。（四）湿热中阻证：【症状】胃脘疼痛，痛势急迫，脘闷灼热，口干口苦，口渴不欲饮，纳呆恶心，小便色黄，大便不畅。舌红，苔黄腻，脉滑数。【方剂应用】基础方剂为清中汤（黄连、栀子、半夏、茯苓、陈皮、草豆蔻、甘草）加减。（五）胃阴亏耗证：【症状】胃脘隐隐灼痛，似饥而不欲食，口干咽燥，口渴思饮，五心烦热，消瘦乏力，大便干结。舌红少津，脉细数。【方剂应用】基础方剂为一贯煎（沙参、麦冬、当归、生地黄、枸杞子、川楝子）合芍药甘草汤（芍药、甘草）加减。（六）脾胃虚寒证：【症状】胃痛隐隐，绵绵不休，喜温喜按，空腹痛甚，得食痛缓，劳累或受凉后发作或加重，时呕清水，神疲纳少，四肢倦怠，手足不温，大便溏薄。舌淡苔白，脉虚弱或迟缓。【方剂应用】基础方剂为黄芪建中汤（炙黄芪、桂枝、生姜、芍药、炙甘草、大枣、饴糖）加减。丹栀逍遥散加减（A错）为月经先期肝郁血热证的方剂应用。月经先期肝郁血热证：【症状】月经周期提前，经量或多或少，经色深红或紫红，质稠，经行不畅，或有块；或少腹胀痛，或胸闷胁胀，或乳房胀痛，或心烦易怒，口苦咽干。舌红，苔薄黄，脉弦数。【方剂应用】基础方剂为丹栀逍遥散（丹皮、栀子、当归、白芍、柴胡、白术、茯苓、煨姜、薄荷、炙甘草）加减。二陈汤加减（C错）为喘证痰浊阻肺证的方剂应用。喘证痰浊阻肺证：【症状】喘而胸满闷塞，甚则胸盈仰息，咳嗽，痰多黏腻色白，咳吐不利，兼有呕恶，食少，口黏不渴。舌苔白腻，脉滑或濡。【方剂应用】基础方剂为二陈汤（陈皮、半夏、茯苓、甘草、生姜、乌梅）合三子养亲汤（紫苏子、白芥子、莱菔子）加减。